全球所面临的城市问题有
A. 住房拥挤、交通堵塞、水源短缺
B. 空气污浊、土地紧张
C. 住房拥挤、交通堵塞、水源短缺、空气污浊、土地紧张
D. 住房拥挤、交通堵塞、水源短缺、空气污浊
E. 以上都是

正确答案：C。住房拥挤、交通堵塞、水源短缺、空气污浊、土地紧张

解析：本题考查全球所面临的城市问题。人口密集使城市资源和环境面临着巨大的压力，因此全球所面临的城市问题有住房拥挤、交通堵塞、水源短缺、空气污浊、土地紧张（C对ABDE错）。